具有补肾阳，祛风湿功效的药组是
A. 补骨脂，益智仁
B. 淫羊藿，巴戟天
C. 沙苑子，淫羊藿
D. 杜仲，补骨脂
E. 鹿茸，肉苁蓉

正确答案：B。淫羊藿，巴戟天

解析：淫羊藿辛甘性温燥烈，功能补肾阳，长于壮阳起痿，宜于肾阳虚衰之男子阳痿不育，也能祛风湿，入肝肾强筋骨，治风寒湿痹，尤宜于久病累及肝肾，筋骨不健，或素体肾阳不足，筋骨不健而患风湿痹证者（B对）。巴戟天辛温能散，有补肾阳、强筋骨、祛风湿之功，能治疗风湿痹痛，筋骨痿软；补骨脂，益智仁都可以补肾阳，用于肾阳虚衰证，但两者都没有祛风湿的功效（A错）；淫羊藿可以补肾阳，强筋骨，祛风湿，但沙苑子能补肾助阳，固精缩尿，养肝明目，而没有祛风湿的功效（C错）；杜仲能补肝肾，强筋骨，安胎，补骨脂能温肾助阳，纳气平喘，温脾止泻，两者都没有祛风湿的功效（D错）；鹿茸可以壮肾阳，益精血，强筋骨，调冲任，托疮毒，肉苁蓉能够补肾阳，益精血，润肠通便，两者都没有祛风湿的功效（E错）。